白前与前胡均有的功效是
A. 降气祛痰
B. 宣散风热
C. 清肺化痰
D. 润肺化痰
E. 化痰软坚

正确答案：A。降气祛痰

解析：本题考查的是白前与前胡的功效。白前与前胡均有的功效是降气祛痰（A对）。白前：【功效】降气祛痰止咳。前胡：【功效】降气祛痰，宣散（B错）风热。川贝母：【功效】清热化痰（C错），润肺（D错）止咳，散结消痈。黄药子：【功效】化痰软坚（E错）散结，清热解毒，凉血止血。